可引起高血钾咳嗽血管神经性水肿的药物是
A. 卡托普利
B. 可乐定
C. 哌唑嗪
D. 肼屈嗪
E. 米诺地尔

正确答案：A。卡托普利

解析：卡托普利可引起肺血管床内缓激肽及前列腺素等物质的聚积，出现刺激性干咳、血管神经性水肿，一般停药后可自行消失（A对）。